在连续对某水体含氮化合物指标进行监测时发现，氨氨、亚硝酸盐氮、硝酸盐氮含量在不同时段变化不一。这些含氮化合物主要来源于
A. 农药
B. 人畜粪便
C. 冶炼废水
D. 医疗废水
E. 难降解有机物

正确答案：B。人畜粪便

解析：本题考查含氮化合物的主要来源。含氮化合物包括有机氮、蛋白氮、氨氮、亚硝酸盐氮和硝酸盐氮。主要来源于动植物，如动物粪便（B对ACDE错）、植物遗体腐败、藻类和原生动物等。